热扰胸膈证的代表方剂是
A. 桂枝汤
B. 桑杏饮
C. 麻杏石甘汤
D. 银翘散
E. 栀子豉汤

正确答案：E。栀子豉汤

解析：栀子豉汤具有清热除烦，宣发郁热之功效，主治热扰胸膈证（E对）。桂枝汤是风寒感冒表虚证的代表方（A错）；桑杏汤是温燥伤肺之轻证的代表方（B错）；麻杏石甘汤是邪热壅肺的代表方（C错）；银翘散是风热感冒的代表方（D错）。